粉体流动性最差的休止角
A. 30度
B. 40度
C. 50度
D. 60度
E. 70度

正确答案：E。70度

解析：本题考查粉末休止角与粉末流动性的关系。休止角反映粉体颗粒间动态摩擦系数大小。休止角越大，摩擦系数越大，粉体的流动性越差，故70度（E对）为粉体流动性最差的休止角。